月经是指
A. 伴随卵巢周期性变化而出现的子宫内膜周期性脱落及出血
B. 月经第一次来潮称为月经初潮，月经的出现是性成熟的主要特征
C. 月经周期的计算是从月经来潮的第1天算起，直到下次月经前一天
D. 月经周期可分为3个阶段：卵泡期、排卵期及黄体期
E. 月经周期的计算是从月经来潮的第1天算起，直到下次月经结束的最后一天

正确答案：A。伴随卵巢周期性变化而出现的子宫内膜周期性脱落及出血

解析：本题考查月经的定义。月经（A对）是伴随卵巢周期性变化而出现的子宫内膜周期性脱落及出血。女性月经第一次来潮称为月经初潮，月经的出现是性成熟的主要特征（B错）。月经周期计算（C错）是从月经来潮的第1天算起，直到下次月经前一天（E错）。月经周期的分期（D错）可分为3个阶段：卵泡期、排卵期及黄体期。